下列外治法，可用于治疗白秃疮、肥疮的是
A. 拔发法
B. 挑治法
C. 挂线法
D. 结扎法
E. 熏法

正确答案：A。拔发法

解析：拨发疗法是剃去病发，以明矾水或肥皂水洗头，在病灶处厚敷癣药膏，用薄膜盖上，包扎或戴帽固定的疗法，适用于白秃疮、肥疮，因为白秃疮、肥疮属于头癣，存在病发（A对）。挑治法适用于内痔出血、肛裂、脱肛、肛门瘙痒、颈部多发性疖肿等（B错）。挂线法适用于疮疡溃后，脓水不净，虽经内服、外敷等治疗无效而形成瘘管或窦道者，或疮口过深，或生于血络丛处而不宜采用切开手术者（C错）。结扎法适用于瘤、赘疣、痔、脱疽等病，以及脉络断裂引起的出血之症（D错）。熏法适用于肿疡、溃疡等（E错）。